医患关系有别于其他类型人际关系的重要特点是
A. 目的性
B. 时限性
C. 平等性
D. 帮助性
E. 依从性

正确答案：B。时限性

解析：时限性是医患关系有别于其他类型人际关系的重要特点，与医患关系的职业性密切相关。掌握“医患关系概述及医患交往的形式和水平”知识点。